患儿，男，5岁。右颌下肿痛3天，灼热，皮色微红，伴恶寒发热，纳呆，舌红苔薄黄，脉滑数。其诊断是
A. 臖核
B. 颈痈
C. 烂疔
D. 流注
E. 红丝疔

正确答案：B。颈痈

解析：臖核可由头面、口腔、四肢等部皮肤损伤或生疮引起，一般单个，在颏颔、颈部、腋部、胯腹部结核如豆，边界清楚，起发迅速，压之疼痛明显，很少化脓破溃，一般无恶寒发热等全身症状（A错）。颈痈为生于颈部两侧或耳后、项下、颏下的急性化脓性疾病，初起局部肿胀、灼热、疼痛，具有明显的风温症状。题中病例为风热、风温之邪袭表，外邪内热挟痰蕴结于少阳、阳明经，气血凝滞，热盛肉腐，故有下颌肿痛，灼热，皮色微红，并伴有恶寒发热，纳呆为痰热之邪阻遏中焦所致（B对）。烂疔是发生于皮肉之间、腐烂甚剧、病势暴急的化脓性疾病，其特点为来势急骤凶险，焮热疼痛，疼痛彻骨，肿胀迅速蔓延，极易化腐，患处皮肉很快大片腐烂卸脱，易并发走黄，危及生命（C错）。流注是发生于肌肉深部的急性化脓性疾病，其特点是好发于四肢躯干肌肉丰厚处的深部或髂窝处，发病急骤，局部漫肿疼痛，皮色如常，容易走窜，常此处为愈，他处又起（D错）。红丝疔是发于四肢，皮肤呈红丝显露，迅速向上走窜的急性感染性疾病，可伴恶寒发热，但其症状为手足生疔部位或皮肤破损处见红肿热痛，继而在前臂或小腿内侧皮肤上气红丝一条或多条，迅速向躯干方选走窜（E错）。